我国现行空气质量标准中的空气污染物基本项目不包括
A. PM₂.₅
B. SO₂
C. NOₓ
D. CO
E. O₃

正确答案：C。NOₓ

解析：本题考查环境空气质量标准的相关内容。我国现行空气质量标准中的空气污染物基本项目包括：PM₂.₅（A对）、SO₂（B对）、CO（D对）、O₃（E对）。NOₓ（C错，为本题正确答案）不是我国现行空气质量标准中的空气污染物基本项目。氮氧化物（NOx）种类很多，造成大气污染的主要是一氧化氮（NO）和二氧化氮（NO₂），因此环境学中的氮氧化物一般就指这二者的总称。